局部振动病主要累及
A. 末梢运动
B. 末梢神经
C. 末梢感觉
D. 末梢循环
E. 毛细血管

正确答案：D。末梢循环

解析：本题考察局部振动病的特点。局部振动又叫手传振动，手传振动可以引起外周循环（D对ABCE错）功能改变，外周血管发生痉挛，表现为皮肤温度降低，冷水负荷试验时皮温恢复时间延长。